诊断急性肺水肿最特异的是
A. 局部哮鸣音
B. 咳吐粉红色泡沫痰
C. 心尖区可闻及奔马律
D. 肺动脉瓣区第二音亢进
E. 气促发绀，烦躁不安

正确答案：B。咳吐粉红色泡沫痰

解析：急性肺水肿的特征是粉红色泡沫样痰（B对）。急性肺水肿会出现突发的严重呼吸困难、端坐呼吸、喘息不止、烦躁不安并有恐惧感（E错），呼吸频率可达30～50次/分；频繁咳嗽或咯出大量粉红色泡沫样血痰；听诊心率快，心尖部常可闻及奔马律（C错）；两肺满布湿啰音和哮鸣音（A错）。肺动脉瓣区第二音亢进是肺动脉高压的体征，并非急性肺水肿最特异的体征（D错）。